心肌兴奋性变化的特点是
A. 绝对不应期短
B. 有效不应期特别长
C. 相对不应期短
D. 超常期特别长
E. 低常期较长

正确答案：B。有效不应期特别长

解析：心肌细胞兴奋性的周期变化：有效不应期（绝对不应期+局部反应期）→相对不应期→超常期。心肌兴奋性变化的特点是有效不应期特别长（B对AC错）（200-300ms），一直延续到心肌收缩活动的舒张早期，使心肌不会发生完全强直收缩，从而保证心脏泵血活动的正常进行。心肌超常期时间较短（D错），没有低常期（E错）。